喹诺酮类引起的不良反应是
A. 伪膜性肠炎
B. 耳毒性
C. 牙釉质发育障碍
D. 肌腱炎
E. 再生障碍性贫血

正确答案：D。肌腱炎

解析：本题考查喹诺酮类药物的不良反应。喹诺酮类抗菌药的不良反应包括腱炎症、跟腱断裂（D对）、心脏毒性、双相血糖紊乱、光毒性、精神神经系统不良反应。